职业禁忌
A. 指用人单位的劳动者在职业活动中，因接触粉尘，放射性物质和其他有毒、有害物质等因素而引起的疾病
B. 指对从事职业活动的劳动者可能导致职业病的各种危害
C. 职业活动中存在的各种有害的化学、物理、生物因素以及在作业过程中产生的其他职业有害因素
D. 指劳动者从事特定职业或者接触特定职业病危害因索时，比一般职业人群更易于遭受职业病危害和罹患职业病或者可能导致原有自身疾病病情加重，或者在从事作业中过程中诱发可能导致对他人生命健康造成危险的疾病的个人特殊生理或者病理状态
E. 统一负责全国职业病防治的监督管理工作

正确答案：D。指劳动者从事特定职业或者接触特定职业病危害因索时，比一般职业人群更易于遭受职业病危害和罹患职业病或者可能导致原有自身疾病病情加重，或者在从事作业中过程中诱发可能导致对他人生命健康造成危险的疾病的个人特殊生理或者病理状态